患者，男，78岁，智力下降，神情呆滞，记忆力和计算力下降，倦怠乏力，齿枯发焦，腰酸腿软，头晕耳鸣，舌质淡红，舌体瘦小，脉沉细弱。治疗应首选的方剂是
A. 还少丹
B. 七福饮
C. 当归活血汤
D. 涤痰汤
E. 半夏白术天麻汤

正确答案：B。七福饮

解析：题中患者智力下降，神情呆滞，记忆力和计算力下降，诊断为痴呆。肾精亏损，精血不足，髓海失养，则齿枯发焦，腰酸腿软，头晕耳鸣；肝肾亏虚，气血不足，则舌质淡红，舌体瘦小，脉沉细弱。故属于髓海不足证。治疗应该首选七福饮，补肾益髓，填精养神（B对）。还少丹补肾健脾，益气生精，为脾肾两虚证之痴呆的代表方（A错）。当归活血汤活血和营凉血解毒，用于疮疡肿毒，色紫而枯者，以及血热所致崩漏，月经不调等（C错）。涤痰汤豁痰开窍，健脾化浊，为痰浊蒙窍证之痴呆的代表方（D错）。半夏白术天麻汤化痰祛湿，健脾和胃，为痰湿中阻证之眩晕的代表方（E错）。